剂量在0.001-0.01g的毒性药物宜配制成
A. 1倍散
B. 10倍散
C. 100倍散
D. 1000倍散
E. 10000倍散

正确答案：C。100倍散

解析：本题考查的是含毒性药物的散剂。剂量在0.001-0.01g的毒性药物宜配制成100倍散（C对）。倍散的稀释比例应根据药物的剂量而定，剂量在0.01-0.1g者，可配制1：10倍散（B错）；剂量在0.001-0.01g，则应配成1：100倍散；剂量在0.001g以下，则应配成1：1000倍散（D错）。